申请执业药师注册的条件包括
A. 取得《执业药师资格证书》
B. 遵纪守法，遵守药师职业道德
C. 身体健康
D. 药学实践1年
E. 在药品生产、经营、使用单位工作

正确答案：A、B、C。取得《执业药师资格证书》；遵纪守法，遵守药师职业道德；身体健康

解析：本题考查执业药师。申请执业药师注册的条件包括：（一）取得《执业药师职业资格证书》（A对）；（二）遵纪守法，遵守执业药师职业道德（B对），无不良信息记录；（三）身体健康（C对），能坚持在执业药师岗位工作；（四）经所在单位考核同意。